患侧呼吸运动减弱，叩诊浊音，可闻及支气管呼吸音者，见于
A. 支气管扩张
B. 支气管哮喘
C. 心源性哮喘
D. 慢性支气管炎
E. 肺炎球菌肺炎

正确答案：E。肺炎球菌肺炎

解析：支气管扩张听诊可听到固定而持久的局限性粗湿罗音（A错）。支气管哮喘发作时胸部呈过度充气状态，双肺广泛哮鸣音，呼吸音延长（B错）。心源性哮喘听诊双肺满布哮鸣音，肺底闻及湿罗音（C错）。慢性支气管炎听诊两肺散在干、湿罗音，其多少及部位不固定（D错）。肺炎球菌肺炎体征听诊呼吸音减低，叩诊轻度浊音，肺实变时叩诊呈浊音，听诊语颤增强和支气管呼吸音（E对）。